患者，男，56岁。素患眩晕，因情急恼怒而突发头痛而胀，继则昏厥仆倒，呕血，不省人事，肢体强痉，舌红苔黄，脉弦。其病机是
A. 气郁
B. 气逆
C. 气脱
D. 气陷
E. 气结

正确答案：B。气逆

解析：气逆证是指气机升降失常，逆而向上所引起的证候，临床可见肺气上逆、胃气上逆、肝气上逆和冲任气逆。上述症状均多因肝主升发、条达，若郁怒伤肝，或肝火内盛，可致肝气升发太过，气血上冲所致，故为肝气上逆（B对）。气郁证的辨证要点以胸胁脘腹或损伤部位的胀闷、胀痛、窜痛为主要表现（A错）。气脱证的辨证要点以以气息微弱、汗出不止、脉微等为主要表现（C错）。气陷证的辨证要点以气短、气坠、脏器下垂为主要表现（D错）。气结证的辨证要点以突发昏厥或绞痛、二便闭塞、鼻粗、脉实为主要表现（E错）。